生命质量的衡量标准不包括
A. 个体生命健康程度
B. 个体生命德才素质
C. 个体生命优化条件
D. 个体生命治愈希望
E. 个体生命预期寿命

正确答案：C。个体生命优化条件

解析：生命质量论是在认同生命神圣的基础上，把注意力集中在对生命质量的考察，主张医学不仅在于保存人的性命，更重要的是要努力提高、增进人的生存质量。个体生命健康程度（A对）、德才素质（B对）、治愈希望（D对）、预期寿命（E对）是生命质量的衡量标准（C错，为本题正确答案）。